牙龈将会受食物直接撞击而受伤是由于
A. 牙冠轴面凸度过大
B. 牙冠轴面凸度过小
C. 牙冠（牙合）外展隙不明显
D. 牙冠（牙合）面副沟排溢道不明显
E. 牙冠（牙合）楔状隙不明显

正确答案：B。牙冠轴面凸度过小

解析：本题考查牙冠轴面突度的生理意义。牙冠轴面凸度过小（B对）为牙龈将会受食物直接撞击而受伤的原因。咀嚼时，正常的牙冠突度可使排溢的食物经过牙龈表面时对牙龈起到生理性按摩作用，促进牙龈的血液循环，有利于牙龈组织的健康。若牙冠突度过小或无突度，牙龈将会受到食物的直接撞击而受伤；反之,若牙冠突度过大（A错），牙龈会失去食物对其的按摩作用，可能产生失用性萎缩。外展隙（C错）的生理意义是保护牙槽骨和牙冠邻面和保持牙面清洁，防止龋病及牙龈炎的发生，楔状隙又称外展隙（E错）。牙冠牙合面副沟排溢道不明显（D错）与食物撞击致牙龈受伤没有直接联系。